寒冷时，机体增加产热量的主要方式是
A. 寒战
B. 甲状腺素的释放量增加
C. 肾上腺素释放量增加
D. 去甲肾上腺素释放量增加
E. 球管平衡

正确答案：A。寒战